下列哪一种因素不会影响缺血－再灌注损伤的发生
A. 缺血时间的长短
B. 组织侧枝循环情况
C. 对氧需求的高低
D. 电解质浓度
E. 组织缺血前状态

正确答案：E。组织缺血前状态

解析：缺血－再灌注损伤的发生常见条件（一）缺血时间：再灌注损伤与缺血时间的长短（A对）有相关性。（二）组织侧枝循环情况（B对）：缺血后侧支循环容易形成者，因缩短缺血时间和减轻缺血程度，不易发生再灌注损伤。（三）对氧需求的高低（C对）：心、脑等需氧量高的器官易发生缺血－再灌损伤。（四）再灌注的条件：再灌注液体压力大小、温度、pH值以及电解质浓度（D对）都与再灌注损伤密切相关。组织缺血前状态（E错，为本题正确答案）不会影响缺血－再灌注损伤的发生。